颞区外伤，导致硬脑膜外血肿，出血多来自
A. 颞浅动脉
B. 颈内动脉颅内段
C. 颞深动脉
D. 脑膜中动脉
E. 大脑前动脉

正确答案：D。脑膜中动脉

解析：脑膜中动脉前支行经颅骨翼点的内面，颞部骨折时该动脉易受损伤，当颞区外伤，导致硬脑膜外血肿，出血多来自脑膜中动脉（D对）。